“十九畏”中，人参“畏”的是
A. 三棱
B. 朴硝
C. 硫黄
D. 五灵脂
E. 密陀僧

正确答案：D。五灵脂

解析：该题考查的是中药的用药禁忌。十九畏：硫黄原是火中精，朴硝一见便相争（BC错）；水银莫与砒霜见，狼毒最怕密陀僧（E错）；巴豆性烈最为上，偏与牵牛不顺情；丁香莫与郁金见，牙硝难合京三棱（A错）；川乌、草乌不顺犀，人参最怕五灵脂（D对）；官桂善能调冷气，若逢石脂便相欺；大凡修合看顺逆，炮爁炙煿莫相依。